女，60岁。性交接触性出血4月余，妇科检查：外阴阴道未见异常，宫颈肥大糜烂质脆，子宫及双附件未见异常。首选确诊项目应是
A. 宫颈细胞学检查
B. 诊断性刮宫
C. 宫腔镜检查
D. HPV检测
E. 宫颈多点活检

正确答案：E。宫颈多点活检

解析：患者为老年女性，接触性出血数月余（宫颈癌常表现为接触性阴道流血），妇检：宫颈肥大糜烂，质脆，应考虑宫颈癌。为明确诊断，首选确诊项目应是宫颈多点活检（E对）。宫颈细胞学检查（P303）（A错）主要用于CIN及早期子宫颈癌筛查，也是诊断的必须步骤，需结合活检病理结果方可确诊。诊断性刮宫（P316）（B错）和宫腔镜检查（P316）（C错）主要用于子宫内膜病变的诊断。HPV检测（D错）主要用于检测有无HPV感染，HPV感染只是宫颈癌的高危因素，不能确诊宫颈癌。